有机磷农药中毒最主要的检查项目是
A. 血象
B. 尿中有机磷代谢产物
C. 吐物中有机磷测定
D. 全血胆碱酯酶活力测定
E. 心电图检查

正确答案：D。全血胆碱酯酶活力测定